男性，34岁，因房屋倒塌压在上半身30min，呼吸困难，体格检查见患者神志清，血压18/14kPa，脉搏100次/min，呼吸30次/min，两眼结膜充血，颈静脉怒张，前胸皮肤淤斑，腹软，无压痛，尿常规正常。最可能的诊断是
A. 早期创伤性休克
B. 创伤性窒息
C. 挤压综合征
D. 皮肤损伤
E. 眼外伤

正确答案：B。创伤性窒息

解析：通过对患者的临床检查以及表现来看，最可能的诊断为创伤性窒息。常见的致伤原因有坑道塌方、房屋倒塌和车辆挤压等。当胸部和上腹部遭受强力挤压的瞬息间，伤者声门突然紧闭，气管及肺内空气不能外溢，两种因素同时作用的结果，引起胸内压骤然升高，压迫心脏及大静脉。上腔静脉系统缺乏静脉瓣，这一突然高压使右心血液逆流而引起静脉过度充盈和血液淤滞，并发广泛的毛细血管破裂和点状出血，甚至小静脉破裂出血。掌握“创伤和战伤”知识点。